为研究甲、乙两种培养基的生长效果是否相同，将100份标本的每一份一分为二，分别接种于甲、乙培养基，所得结果为：甲、乙培养基均生长的有30份，甲生长、乙不生长的25份，甲不生长、乙生长的35份，甲、乙均不生长的10份。据此资料与研究目的
A. 宜将资料整理后作t检验
B. 宜将资料整理后作成组设计四格表χ²检验
C. 宜将资料整理后作成组设计秩和检验
D. 宜将资料整理后作行×列表χ²检验
E. 宜将资料整理后作配对设计四格表χ²检验

正确答案：E。宜将资料整理后作配对设计四格表χ²检验